下唇麻木是以下哪一种阻滞麻醉注射的成功标志
A. 上牙槽后神经阻滞麻醉
B. 眶下神经阻滞麻醉
C. 腭前神经阻滞麻醉
D. 鼻腭神经阻滞麻醉
E. 下牙槽神经阻滞麻醉

正确答案：E。下牙槽神经阻滞麻醉

解析：下牙槽神经阻滞麻醉麻醉区域及效果：同侧下颌骨、下颌牙、牙周膜、前磨牙至中切牙唇（颊）侧牙龈、黏骨膜及下唇部，以下唇麻木为注射成功的主要标志。掌握“颌面部常用局麻法及牙拔除的麻醉选择”知识点。